下列哪项因素不参与胆囊收缩的调节
A. 促胃液素
B. 缩胆囊素
C. 促胰液素
D. 迷走神经
E. 胆盐

正确答案：E。胆盐